主要兴奋β受体的拟肾上腺素药是
A. 去甲肾上腺素
B. 肾上腺素
C. 间羟胺
D. 异丙肾上腺素
E. 多巴胺

正确答案：D。异丙肾上腺素

解析：异丙肾上腺素（D对）对β受体激动作用较强，对β₁、β₂受体无明显选择性，对α受体几乎无作用，临床用于支气管哮喘，用于控制支气管哮喘急性发作，用于治疗房室传导阻滞以及心室自身节律缓慢，高度房室传导阻滞或窦房结功能衰竭而并发的心脏骤停。去甲肾上腺素（A错）（NA）对α受体有强大的激动作用，对β₁受体作用较弱，对β₂受体几乎无作用，临床主要用于休克早期血压骤降时，小剂量短时间静脉滴注以保证心、脑等主要器官的血液供应。肾上腺素（B错）为α、β受体激动剂，临床主要用于过敏性休克、心脏骤停、支气管哮喘，还可以和局麻药一起延缓局麻药的作用时间。间羟胺（C错）直接兴奋α受体，对β受体作用较弱，临床上可替代NA用于各种休克早期期以及手术或脊椎麻醉后的休克。多巴胺（E错）属于去甲肾上腺素生物合成的前体，主要激动α、β受体以及外周多巴胺受体，临床主要用于治疗各种休克，如心源性休克、感染性休克和出血性休克等。